治疗郁证日久，阴虚火旺者，应首选
A. 丹栀逍遥散
B. 知柏地黄丸
C. 天王补心丹
D. 六味地黄丸
E. 滋水清肝饮

正确答案：E。滋水清肝饮

解析：郁证病位在肝，郁证日久，肝郁化火，火郁伤阴，致肝肾阴亏，阴虚火旺，治宜滋养阴精，补益肝肾。丹栀逍遥散功能疏肝解郁，清肝泻火，适用于肝郁化火证而阴未伤，为郁证气郁化火证的选方（A错）。知柏地黄丸功能滋阴降火，主治肝肾阴虚，虚火上炎证（B错）。天王补心丹功能滋阴清热，养心安神（C错）。六味地黄丸功能滋补肝肾，主治肝肾阴虚证（D错）。滋水清肝饮由六味地黄丸和丹栀逍遥散加减而成，以六味地黄丸补肾阴而养肝阴，以丹栀逍遥散去白术疏肝解郁，清热泻火，为治疗郁证日久，阴虚火旺的首选方（E对）。